女，45岁，晨起左中指发僵疼痛，缓慢活动后可消失，曲伸中指时有弹响，最可能的诊断是
A. 狭窄性腱鞘炎
B. 创伤性关节炎
C. 类风湿性关节炎
D. 滑囊炎
E. 腱鞘囊肿

正确答案：A。狭窄性腱鞘炎

解析：患者为中年女性（腱鞘炎好发人群），晨起左中指发僵疼痛、活动后可消失，屈伸中指时有弹响（狭窄性腱鞘炎典型表现），故该患者最可能的诊断为左中指狭窄性腱鞘炎（A对）。狭窄性腱鞘炎好发于长期快速过度用力使用手指和腕关节的中老年妇女、轻工业工人等，典型表现为患指弹响伴明显的疼痛。创伤性关节炎（B错）为骨折的晚期并发症，多见于关节内骨折，表现为关节活动时出现疼痛。类风湿性关节炎（C错）主要表现为反复发作的、对称性的、多发性小关节炎，以近端指间关节、掌指关节最为多见。滑囊炎（D错）表现为关节或骨突出部逐渐出现的一圆形或椭圆形肿物，缓慢长大伴有压痛，晚期可见关节部位肌肉萎缩。腱鞘囊肿（E错）是关节附近的一种囊性肿块，多发于腕背、桡侧腕屈肌腱或足背部，肿物生长缓慢，长大到一定程度活动关节时有酸胀感，无晨起发僵和弹响。